11个月男婴，Ⅱ度烧伤面积10%，体重10公斤，额外丢失液量为
A. 100ml
B. 150ml
C. 200ml
D. 250ml
E. 300ml

正确答案：C。200ml

解析：烧伤患者的体液丢失量（即需补充液体量）可根据病人的烧伤面积和体重进行计算。根据九版外科学补液方案计算，小儿烧伤后，在第一个24小时内，每1%烧伤面积（Ⅱ度、Ⅲ度）每公斤体重额外丢失补液量为1.5ml，该患儿烧伤面积为10%，体重10公斤，则其额外丢液量=烧伤面积（Ⅱ度、Ⅲ度）×体重×1.5=10×10×1.5=150ml，但在实际临床应用中普遍认为此观点有误。七版外科学P183和七版黄家驷外科学P90都明确说明小儿烧伤后，在第一个24小时内，每1%烧伤面积（Ⅱ度、Ⅲ度）每公斤体重额外丢失补液量为2.0ml，故其额外丢液量=烧伤面积（Ⅱ度、Ⅲ度）×体重×2=10×10×2=200ml（C对）。